患者，女,60岁，有反复尿路感染病史5年,3天前因劳累而复发。发症：小便淋沥不已，时作时止，伴腰膝酸软，神疲乏力，舌淡，脉细弱。其辩证是
A. 热淋
B. 血淋
C. 气淋
D. 膏淋
E. 劳淋

正确答案：E。劳淋

解析：淋证分六种，热淋、石淋、血淋、气淋、膏淋、劳淋。六种淋证均有小便频涩，滴沥刺痛，小腹拘急引痛，而各种淋证又有各自的特殊表现。热淋起病多急骤，小便赤热，溲时灼痛，或伴有发热，腰痛拒按；石淋以小便排出砂石为主症，或排尿时突然中断，尿道窘迫疼痛，或腰腹绞痛难忍；气淋小腹胀满较明显，小便艰涩疼痛，尿后余沥不尽；血淋为溺血而痛；膏淋证见小便混浊如米油水或滑腻如膏脂；劳淋小便不甚赤涩，溺痛不甚，但淋沥不己，时作时止，遇劳即发。此患者小便淋沥，遇劳而发，腰膝酸软，乏力，为劳淋（E对）。